斜刺法的进针角度是
A. 15°左右
B. 30°左右
C. 45°左右
D. 70°左右
E. 90°左右

正确答案：C。45°左右

解析：斜刺是针身与皮肤表现约呈45°刺入（C对）。平刺指针身与皮肤表面呈15°左右或以更小的角度刺入体内。此法适用于皮薄肉少部位的腧穴（A错）。直刺是针身与皮肤表面呈90°（E错）。